关于肝素和低分子肝素作用特点的说法，错误的是
A. 皮下给药，低分子肝素的生物利用度接近100%
B. 肝素与低分子肝素相比，起效快失效也快
C. 低分子肝素抗凝作用维持时间较长，可以一日1次或2次给药
D. 肝素与低分子肝素均可使用硫酸鱼精蛋白迅速逆转抗凝作用
E. 与肝素相比，低分子肝素给药相对方便且不会通过胎盘屏障，是妊娠期首选的抗凝药

正确答案：D。肝素与低分子肝素均可使用硫酸鱼精蛋白迅速逆转抗凝作用

解析：本题考查肝素和低分子肝素作用特点。对于肝素所致的出血可用鱼精蛋白来拮抗。低分子肝素属于温和的抗凝药物，一般用于预防血栓和血栓的治疗，如果出血较严重，可以减少用量或者停止该药物的使用（D错，为本题正确答案）。肝素和低分子肝素作用特点：低分子肝素以皮下注射为主，生物利用度接近100%（A对）；（2）普通肝素起效和失效快（B对），可根据需要更加灵活地调整剂量或停药；（3）低分子肝素抗凝作用持续时间较长，因此可以一日仅给药1次或2次（C对）；（4）低分子肝素起效略慢；（5）低分子肝素为妊娠期首选的抗凝药（E对）。由于普通肝素和低分子肝素均不会在乳汁中积聚，所以哺乳期妇女可以使用。